具有氨基酮结构的镇痛药
A. 吗啡
B. 美沙酮
C. 哌替啶
D. 盐酸溴己新
E. 羧甲司坦

正确答案：B。美沙酮

解析：本题考查氨基酮类镇痛药。具有氨基酮结构的镇痛药是美沙酮(B对)。氨基酮类药物可以看作是仅仅保留吗啡结构中的A环类似物，也可以被称为二苯基庚酮类或苯基丙胺类，代表药物美沙酮。吗啡（A错）是具有菲环结构的生物碱，是由5个环稠和而成的复杂立体结构,有效的吗啡构型是左旋吗啡。哌替啶（C错）属于4-苯基哌啶类的结构的镇痛药。盐酸溴己新（D错）是具有苯甲胺结构的祛痰药。羧甲司坦（E错）是具有氨基酸结构的祛痰药。